英国药典的缩写是
A. BP
B. USP
C. ChP
D. EP
E. JP

正确答案：A。BP

解析：本题考查药典。英国药典的缩写是BP（A对）。BP为《英国药典》的缩写。USP（B错）为《美国药典》的缩写。 ChP（C错）为《中国药典》的缩写。EP（D错）为《欧洲药典》的缩写。JP（E错）为《日本药局方》的缩写。